第一个问世的质子泵抑制剂的药物是
B. 雷贝拉唑
C. 泮妥拉唑
D. 奥美拉唑
E. 兰索拉唑

正确答案：D。奥美拉唑

解析：本题考查质子泵抑制剂的发展历程。第一个问世的质子泵抑制剂的药物是奥美拉唑（D对）。奥美拉唑是第一个问世的质子泵抑制剂，于1988年首次在瑞士上市，有较强的抑制胃酸作用，主要用于十二指肠溃疡和卓-艾综合征，也可用于胃溃疡和反流性食管炎。埃索美拉唑（A错）是以单一光学异构体上市的不可逆质子泵抑制剂的药物。